新生儿窒息复苏评估的三大指标是
A. 呼吸，皮肤颜色，哭声
B. 呼吸，心率，哭声
C. 心率，呼吸，皮肤颜色
D. 心率，呼吸，肌张力
E. 心率，皮肤颜色，肌张力

正确答案：C。心率，呼吸，皮肤颜色

解析：皮肤颜色、心率、对刺激的反应、肌张力和呼吸五项指标属于Apgar评分（P97）的内容（ABDE错）。Apgar评分是国际上公认的评价新生儿窒息的最简捷、实用的方法。五项指标中呼吸、心率和血氧饱和度（C对）是窒息复苏评估的三大指标。